女，25岁。溢乳并继发性闭经1年，无孕产史。妇科检查未见异常。实验室检查：血PRL升高。蝶鞍MRI发现垂体萎缩，首选的治疗措施是
A. 应用溴隐亭
B. 应用GnRH-a
C. 手术治疗
D. 应用氯米芬
E. 放射治疗

正确答案：A。应用溴隐亭

解析：该患者为生育期女性，溢乳并继发性闭经1 年，无孕产史（高催乳素血症多表现为不孕，月经少、稀发至闭经，溢乳），血PRL（催乳素）升高（高催乳素血症血PRL升高），蝶鞍MRI发现垂体萎缩，考虑为垂体催乳素瘤引起的高催乳素血症。治疗首选溴隐亭（A对），其通过与垂体多巴胺受体结合，直接抑制垂体PRL分泌，使闭经-溢乳妇女月经和生育能力得以恢复，溴隐亭还可直接抑制垂体肿瘤细胞生长；当垂体肿瘤产生明显压迫及神经系统症状或药物治疗无效时，应考虑手术切除肿瘤（C错）；放射治疗（E错）则主要用于不能坚持或耐受药物治疗者，愿意手术者，不能耐受手术者。应用GnRH-a（促性腺激素释放激素）（P358）（B错）主要用于下丘脑性闭经。氯米芬（P358）（D错）是最常用的促排卵药，适用于有一定内源性雌激素水平的无排卵者。